使用糖皮质激素，可能引起多种不良反应和并发症。关于糖皮质激素类药物的不良反应属于隐匿的或延迟的不良反应
A. 消瘦
B. 骨质疏松症、白内障
C. 肾上腺皮质功能不足症状
D. 情绪不稳定、失眠
E. 溃疡性结肠炎

正确答案：B。骨质疏松症、白内障

解析：本题考查糖皮质激素的不良反应。使用糖皮质激素可导致隐匿的或延迟的不良反应包括：骨质疏松症（B对）、皮肤萎缩、白内障、动脉粥样硬化、生长迟滞、脂肪肝。